含淀粉的饮片易
A. 散失气味
B. 虫蛀、霉变
C. 泛油、酸败
D. 风化、潮解
E. 变色、软化

正确答案：B。虫蛀、霉变

解析：本题考查的是自身因素对中药质量变异的影响。含淀粉的饮片易虫蛀、霉变（B对）。自身因素对中药质量变异的影响：1.水分：一般饮片均含有一定量的水分，所含水分又因其组成成分和内部结构不同而存在结晶水、自由水、结合水、吸湿水等，而含水量则与其质量有着密切的关系。如果含水量高于或低于饮片本身应有的水分含量，就易发生质量的变化。水分过高，饮片容易发生虫蛀、霉烂、潮解、粘连等。反之，若水分过低，饮片又会发生风化（D错）、气味散失、泛油、干裂、脆化等现象。目前，测定饮片含水量的方法很多，主要有烘干法、甲苯法、减压干燥法、气相色谱法等。2.淀粉：淀粉是一种适合蛀虫、霉菌生长的营养基质，同时，含淀粉较多的饮片很容易吸收水分，当表面水分增加时，更便于霉菌、虫卵繁殖，因此淀粉含量高的饮片容易发生虫蛀、霉变。3.黏液质：黏液质是一种近似树胶的多糖类物质，它存在于植物细胞中。黏液质遇水后会膨胀发热，既易于发酵，又是微生物、虫卵的营养基质。因此，含黏液质的饮片也易于发霉、生虫。如枸杞子、天冬等。4.油脂：油脂是脂肪油和脂肪的总称，分植物性油脂和动物性油脂两大类。含油脂的饮片，若长时间与空气、日光、湿气等接触，或因微生物的作用，会发生氧化反应，继而发生异味、酸败（C错）等现象。油脂也易在脂酶影响下水解，形成甘油和脂肪酸而具有异味。如桃仁、杏仁、刺猬皮、狗肾等。5.挥发油：挥发油在植物药材中分布较广，特别是伞形科、唇形科、樟科、姜科等植物中，其含量都极为丰富，如白芷、当归、荆芥、薄荷、肉桂、樟脑、姜黄、山柰等。含挥发油的药物，都具有不同的浓郁气味，长期与空气接触，随着油分的挥发，其气味会随之减弱（A错），且在温度较高时，会加速挥发。6.色素：一般饮片都含有不同的色素，特别是花类饮片。颜色从外观上反映了饮片的质量，不仅作为鉴别中药品质的重要标志，同时也直接关系到药材加工质量的优劣。但有些色素很不稳定，易受到日光、空气等影响而遭到破坏，受潮后也易发霉变色（E错），如月季花、玫瑰花等。7.鞣质：鞣质是广泛存在于中药饮片中的一类分子较大的多元酚类化合物，按化学结构可分为水解鞣质和缩合鞣质。五味子、石榴皮、大黄、丁香等含有水解鞣质，水解鞣质可被酸、碱、酶所催化水解而失去鞣质特性；虎杖、桂皮、四季青、钩藤等含有缩合鞣质，缩合鞣质不能水解但长期接触空气，在酶的影响下容易氧化，缩合成暗红色或更深颜色的鞣红沉淀。因此，含有该类成分的中药饮片，若长期储存或加工炮制，都会引起颜色变化。8.无机化合物：含有无机化合物的矿物类饮片，主要的成分有钠、钙、铁、铜、汞、砷、铅等化合物。这些化合物，在外界因素影响下，容易产生物理、化学性的变化。如磁石在空气中久置会失去磁性。9.树脂：树脂类中药饮片如乳香、没药、血竭、安息香等，由植物的黏稠汁液采集加工而成。该类饮片软化点、熔点较低，高温储存或日晒常部分融化、粘连；个别品种如阿魏夏季易吸附水汽，由固态变为黏稠液体；秋冬季又会散失水分，变为黏硬的固体。